实现“2000年人人享有健康”这个战略目标的基本策略和关键途径是
A. 初级卫生保健
B. 健康教育
C. 健康保护
D. 健康管理
E. 健康促进

正确答案：A。初级卫生保健

解析：本题考查初级卫生保健。实现“2000年人人享有健康”这个战略目标的基本策略和关键途径是初级卫生保健（A对BCDE错）。初级卫生保健指的是那些国家和地区能够负担得起的基本的卫生保健服务，这些服务呆用的方法和技术是可行、科学上合理、且能为社会所接受的。社区中的每个个体和家庭都能获得这些基本的服务。